肝藏血与脾统血的共同生理功能是
A. 贮藏血液
B. 调节血量
C. 统摄血液
D. 防止出血
E. 化生血液

正确答案：D。防止出血

解析：本题考查肝藏血与脾统血的共同生理功能，属于理解记忆内容。肝藏血，是指肝脏具有贮藏血液、调节血量和防止出血的功能。脾主统血，是指脾气有统摄、控制血液在脉中正常运行而不逸出脉外的功能，肝藏血与脾统血的共同生理功能是防止出血（D对）。肝不具有化生血液、统摄血液的作用（CE错），脾不具有贮藏血液、调节血量的作用（AB错）。